因大气污染造成的死亡经济损失计算没有考虑
A. 因病误工天数
B. 当地人年均工资
C. 暴露引起的超死亡人数
D. 当地的人均月工资
E. 人均医疗费用

正确答案：D。当地的人均月工资

解析：本题考查死亡经济损失的计算。在因大气污染造成的死亡经济损失的计算中，应考虑因病误工天数（A对）、当地人年均工资（B对）、暴露引起的超死亡人数（C对）和人均医疗费用（E对）。当地的人均月工资（D错，为本题正确答案）不在造成的死亡经济损失的计算范围中。